患儿，6岁。发热2天，出现淡红色小丘疹，根盘红晕，丘疹上部可见疱疹，形态椭圆，胞浆清亮，皮疹以躯干为多，苔薄白，脉浮数。其治法是
A. 疏风清热，利湿解毒
B. 清气凉营，解毒化湿
C. 发散风寒，清热利湿
D. 芳香化湿，兼以健脾
E. 清解郁热，活血化瘀

正确答案：A。疏风清热，利湿解毒

解析：题中患儿发热，出现淡红色小丘疹，根盘红晕，形态椭圆，胞浆清亮，并以躯干为多，故诊断为水痘。苔薄白，脉浮数为风热犯表之象，故辨为邪伤肺卫证，外邪与内湿相搏，外透肌肤，故出现淡红色小丘疹，邪轻病浅，故根盘红晕，丘疹上部可见疱疹，形态椭圆，胞浆清亮。治宜疏风清热，利湿解毒（A对）。清气凉营，解毒化湿为水痘邪炽热盛的治法（B错）。水痘总的治疗原则为解毒利湿，其他选项无解毒之功（CDE错）。